“用寒远寒，用热远热”，属于
A. 因病制宜
B. 因地制宜
C. 因人制宜
D. 因时制宜
E. 因证制宜

正确答案：D。因时制宜

解析：本题考查对三因制宜的理解。用寒远寒，用热远热的意思是用寒凉方药及食物时，当避其气候之寒凉；用温热方药及食物时，当避其气候之温热，明显体现了因时制宜（D对），而不是因地（B错）因人制宜（C错）。此题考查三因制宜，因病制宜和因证制宜为混淆选项（AE错）。